脑脊液中浓度最高的是
A. 大观霉素
B. 庆大霉素
C. 氯霉素
D. 土霉素
E. 米诺环素

正确答案：C。氯霉素

解析：本题考查氯霉素。氯霉素（C对）为酰胺醇类，脂溶性高，能够透过血脑屏障。脑膜有炎症时，其浓度可达血浆药物浓度的45%～89%，脑脊液中浓度最高。